番泻叶的性状鉴别特征主要有
A. 长卵形或卵状披针形
B. 边缘具细密锯齿
C. 上下表面均为红棕色
D. 气微弱而特异
E. 味微苦，稍有黏性

正确答案：A、D、E。长卵形或卵状披针形；气微弱而特异；味微苦，稍有黏性

解析：本题考查的是番泻叶药材的性状鉴别。番泻叶的性状鉴别特征主要有长卵形或卵状披针形（A对）、气微弱而特异（D对）与味微苦，稍有黏性（E对）。番泻叶：【性状鉴别】药材狭叶番泻呈长卵形或卵状披针形，叶端急尖，叶基稍不对称，全缘（B错）。上表面黄绿色，下表面浅黄绿色（C错），无毛或近无毛，叶脉稍隆起。革质。气微弱而特异，味微苦，稍有黏性。